根据《执业药师资格制度暂行规定》，《执业药师资格证书》的有效范围是
A. 在全国范围内有效
B. 在颁发机关所在省份内有效
C. 在取得者的居住地省份内有效
D. 在取得者的就业所在地有效
E. 在取得者的身份证发放地有效

正确答案：A。在全国范围内有效

解析：本题考查的是《执业药师资格证书》的有效范围。根据《执业药师资格制度暂行规定》，《执业药师资格证书》的有效范围是在全国范围内有效（A对）。《执业药师资格制度暂行规定》第十条规定，执业药师资格考试合格者，由各省、自治区、直辖市人事（职改）部门颁发人事部统一印制的、人事部与国家药品监督管理局用印的中华人民共和国《执业药师资格证书》。该证书在全国范围内有效。